创伤后人体代谢变化为
A. 蛋白分解增加、糖异生增加、脂肪分解增加
B. 蛋白分解增加、糖异生减少、脂肪分解减少
C. 蛋白分解增加、糖异生减少、脂肪分解增加
D. 蛋白分解减少、糖异生增加、脂肪分解增加
E. 蛋白分解减少、糖异生减少、脂肪分解减少

正确答案：A。蛋白分解增加、糖异生增加、脂肪分解增加

解析：创伤后机体处于应激状态，儿茶酚胺、糖皮质激素释放增加，脂肪和蛋白质分解增加，糖异生增加（A对）。